患者，男，45岁。1月前因突发右侧肢体无力、言语障碍就诊，诊断为缺血性脑卒中，现服用阿托伐他汀钙片，每晚1次，每次20mg。该患者LDL-C的控制目标值是
A. ＜1.8mmol/L
B. ＜4.4mmol/L
C. ＜3.4mmol/L
D. ＜2.6mmol/L
E. ＜1.0mmol/L

正确答案：A。＜1.8mmol/L

解析：本题考查LDL-C的控制目标值。该患者LDL-C的控制目标值是<1.8mmol/L（A对）。目前对于缺血性脑卒中或TIA患者他汀类药物治疗的推荐基于其降低LDL-C的强度而非目标值。综合中国国情和国际指南建议，推荐他汀类药物治疗的强度分为高强度（LDL-C降低≥50%）和中等强度（LDL-C降低30%～50%）。在实际工作中，LDL-C的目标值仍然是临床医生评估他汀类药物治疗疗效和依从性的重要参考，建议将“LDL-C<1.8mmol/L”作为评估降低胆固醇治疗的参考目标值。